能升高血钾的利尿药物是
A. 呋塞米
B. 氢氯噻嗪
C. 乙酰唑胺
D. 氨苯蝶啶
E. 甘露醇

正确答案：D。氨苯蝶啶

解析：本题考查利尿药。能升高血钾的利尿药物是氨苯蝶啶（D对）。氨苯蝶啶为保钾利尿药，常见不良反应为高钾血症。呋塞米（A错）、氢氯噻嗪（B错）均可发生低钾血症的不良反应。乙酰唑胺（C错）是碳酸酐酶抑制剂，常见代谢性酸中毒、肾结石等不良反应。甘露醇（E错）是渗透性利尿药，常见不良反应有水肿和电解质紊乱、渗透性肾病、血栓性静脉炎等。